不是结核分枝杆菌特性的是
A. 生长慢并有分枝生长的趋势
B. 抗酸染色阳性
C. 专性需氧
D. 营养要求不高
E. 毒力和耐药性均可发生变异

正确答案：D。营养要求不高

解析：结核分枝杆菌为专性需氧菌，营养要求高。在含有蛋黄、马铃薯、甘油和天冬酰胺等的固体培养基上才能生长，且生长缓慢，约12～24小时繁殖一代。掌握“结核、非结核分枝杆菌”知识点。